可摘局部义齿就位困难的原因不可能是
A. 环臂过紧
B. 卡环体进入基牙倒凹
C. 基托进入倒凹
D. （牙合）支托咬合高
E. 义齿变形

正确答案：D。（牙合）支托咬合高

解析：本题考查义齿就位困难的原因。可摘局部义齿就位困难的原因不可能是（牙合）支托咬合高（D错，为本题正确答案）。（牙合）支托咬合高，一方面会引起基牙疼痛，另一方面过高的（牙合）支托可在牙面形成支点，造成义齿固位不良，因而（牙合）支托咬合高不是引起义齿就位困难的原因。造成义齿就位困难的原因有环臂过紧（A对）、倒凹填补不够，制作支架时磨损模型，以致卡环体进入基牙倒凹（B对）、人工牙或是基托进入倒凹（C对）、义齿变形（E对）。